高温作业工人患病率较高的疾病是
A. 心血管疾病
B. 泌尿系统疾病
C. 神经系统疾病
D. 心血管和消化系统疾病

正确答案：D。心血管和消化系统疾病

解析：本题考查高温作业工人易患疾病。①循环系统：高温环境下从事体力劳动时，如果高温劳动者在劳动时已达最高心率，机体蓄热又不断增加，心输出量无法继续增加以维持血压和肌肉灌流，可能导致热衰竭。血压改变没有明确的规律，长期高温劳动者可出现心脏代偿性肥大；②消化系统：高温作业时，消化酶活性降低，胃肠道的收缩和蠕动减弱，引起食欲减退和消化不良，胃肠道疾患增多，且工龄越长，患病率越高（D对ABC错）；③神经系统：高温作业可使中枢神经系统出现抑制，不仅导致工作效率的降低，且易发生工伤事故；④泌尿系统：高温作业时，大量水分经汗腺排出，由于血液浓缩使肾脏负担加重，可致肾功能不全，尿中出现蛋白、红细胞、管型等。